维生素B₁₂在回肠末端部位的吸收方式属
A. 滤过
B. 简单扩散
C. 主动转运
D. 易化扩散
E. 膜动转运

正确答案：C。主动转运

解析：本题考查药物的转运方式。维生素B₁₂在回肠末端部位吸收均属于主动转运（C对）；滤过（A错）是指水溶性的极性或非极性药物分子借助于流体静压或渗透压随体液通过细胞膜的水性通道而进行的跨膜转运；简单扩散（B错）是指脂溶性药物溶解于细胞的脂质层，顺浓度差通过细胞膜，又称脂溶性扩散；易化扩散（D错）具有载体转运的各种特征，实际上是一种被动转运；膜动转运（E错）是指生物膜具有一定的流动性，它可以通过主动变形，膜凹陷吞没液滴或微粒，将某些物质摄入细胞内或从细胞内释放到细胞外。